女，59岁。因高热、腹泻静脉点滴庆大霉素治疗，5天后出现恶心、呕吐、伴少尿。査血白细胞总数及分类正常，尿比重1.010，蛋白（+），红细胞0～2/HP，白细胞3～5/HP。血肌酐320umol/L，尿素氮17mmol/L，尿钠100mmol/L。该患者肾衰最可能的原因是
A. 急性肾小管坏死
B. 急性间质性肾炎
C. 急进性肾小球肾炎
D. 肾前性氮质血症
E. 急性肾小球肾炎

正确答案：A。急性肾小管坏死

解析：患者为中老年女性，因高热、腹泻静脉点滴庆大霉素（肾毒性药物）5天后出现恶心、呕吐、伴少尿（急性肾衰表现），实验检查示：尿比重及尿红、白细胞正常，蛋白（+），血肌酐320umol/L【正常值（女）70～108μmol/L】，尿素氮17mmol/L（正常值2.86～7.14mmol/L），尿钠l00mmol/L（急性肾小管坏死尿钠浓度＞40mmol/L），综合患者病史、临床表现及实验室检查，考虑为庆大霉素导致的急性肾小管坏死（A对）。急性间质性肾炎（B错）可出现在应用抗生素后，可出现肾小球及肾小管损伤而导致蛋白尿及尿量增多或肾性糖尿，多不会出现肾衰竭表现，该患者的实验室检查已然提示肾衰竭，因此可排除该诊断。